婴幼儿发育最快的时期是
A. 新生儿期
B. 婴儿期
C. 幼儿期
D. 学龄前期
E. 学龄期

正确答案：B。婴儿期

解析：婴儿期是婴幼儿发育最快的时期（B对）。（P26）新生儿期，生后1周内的新生儿发病率和死亡率极高，婴儿死亡中约2/3是新生儿，<1周的新生儿的死亡数占新生儿期死亡数的70%左右（A错）。（P28）由于感知能力和自我意识的发展，对周围环境产生好奇。乐于模仿，幼儿期是社会心理发育最为迅速的时期（C错）。（P28）学龄前期儿童的智能发展快、独立活动范围大，是性格形成的关键时期（D错）。（P28）学龄期 此期儿童求知欲强，是获取知识的最重要时期（E错）。